5个总体率比较的行×列表资料χ²检验的无效假设是5个总体率
A. 至少有2个相等
B. 至少有3个相等
C. 至少有4个相等
D. 全相等
E. 各不相等

正确答案：D。全相等